全面、完整的健康教育项目应开始于科学的
A. 计划
B. 规划
C. 设计
D. 分析
E. 诊断

正确答案：C。设计